下列血管不属于锁骨下动脉分支的是
A. 甲状腺上动脉
B. 椎动脉
C. 胸廓内动脉
D. 甲状颈干
E. 肋颈干

正确答案：A。甲状腺上动脉

解析：甲状腺上动脉（A错，为本题正确答案）为颈外动脉的分支。椎动脉（B对）、胸廓内动脉（C对）、甲状颈干（D对）、肋颈干（E对）均为锁骨下动脉的主要分支。